治疗甲状腺功能亢进症的药物有
A. 瑞格列奈
B. 丙硫氧嘧啶
C. 放射性碘
D. 酚妥拉明
E. 普萘洛尔

正确答案：B、C、E。丙硫氧嘧啶；放射性碘；普萘洛尔

解析：本题考查治疗甲亢的药物。常用的治疗甲亢的药物：1.硫脲类，如甲硫氧嘧啶、丙硫氧嘧啶（B对）、甲巯咪唑、卡比马唑等。2.碘及碘化物，如复方碘溶液、碘化钾、碘化钠等。3.放射性碘（C对）。4.β受体拮抗剂，如普萘洛尔（E对）、美托洛尔、阿替洛尔等。瑞格列奈（A错）为非磺酰脲类降糖药。酚妥拉明（D错）是非选择性α受体阻断剂，用于抗休克，治疗外周血管痉挛性疾病、肾上腺嗜铬细胞瘤。